链霉素和红霉素抗菌作用针对的细菌结构部位是
A. 细胞壁上肽聚糖
B. 细胞壁上脂多糖
C. 细胞质中核蛋白体
D. 细胞膜上中介体
E. 细胞染色体DNA

正确答案：C。细胞质中核蛋白体

解析：链霉素属于氨基糖苷类抗生素，抗菌的主要机制是通过与细胞质中核蛋白体的结合而抑制细菌蛋白质的合成（细菌蛋白质的合成包括起始、延长和终止阶段，都有核蛋白体的参与）。红霉素属于大环内酯类抗生素，抗菌机制为不可逆地结合到细菌核蛋白体上，选择性地抑制细菌蛋白质的合成。由此可知，链霉素和红霉素抗菌作用针对的细菌结构部位是细胞质中核蛋白体（C对）。青霉素类抗菌药的作用是针对细菌细胞壁的肽聚糖（A错）。喹诺酮类抗生素作用于细胞染色体DNA（E错），通过抑制细菌DNA的复制而产生杀菌作用。暂无抗菌药的作用靶点是细胞壁上脂多糖（B错）和细胞膜上中介体（D错）。